（）中毒时血液中会出现点彩红细胞
A. 铅
B. 汞
C. 苯
D. 苯胺

正确答案：A。铅

解析：本题考查铅中毒的临床表现。职业性铅中毒多为慢性中毒，慢性铅（A对BCD错）中毒在血液及造血系统中，可有轻度贫血，多呈低色素正常细胞型贫血，另外出现点彩红细胞和网织红细胞增多等症状。